有关溃疡性息肉描述正确的是
A. 表面无上皮覆盖
B. 粉红色
C. 不易出血
D. 复层扁平上皮覆盖
E. 镜下见增生的炎症性组织表面有复层鳞状上皮覆盖

正确答案：A。表面无上皮覆盖

解析：本题考查牙髓息肉。有关溃疡性息肉描述正确的是表面无上皮覆盖（A对）。牙髓息肉可分为两种：一种为溃疡性息肉，表面无上皮覆盖，呈暗红色，有纤维所凝聚的黄色斑，探易出血，镜下主要表现为增生的炎性肉芽组织，表面无上皮覆盖；另一种为上皮性息肉，表面有复层扁平上皮覆盖，较坚实，粉红色，不易出血，镜下见增生的炎症性组织表面有复层鳞状上皮覆盖。